女婴，30天。过期产，出生体重4.5kg，母亲无糖尿病史。生后人工喂养，常鼻塞，时有呼吸困难，吃奶差。哭声弱、反应差、便秘，体检：T35℃，P90次/分，皮肤轻度黄染。血象：HB90g/L.RBC.3.6×10¹²/L，WBC11×10⁹/L。对该儿最主要的治疗是
A. 应用抗生素抗感染
B. 保肝、利胆、退黄
C. 不需用药，继续观察
D. 保暖给氧，支持呼吸
E. 服用甲状腺制剂

正确答案：E。服用甲状腺制剂

解析：婴儿，过期产，生后人工喂养，常鼻塞，时常有呼吸困难，吃奶差，哭声弱、反应差、便秘（甲状腺功能减低的特征性症状），体检：T35℃（正常值为36℃～37℃，提示体温降低），P90次/分（正常值为110-130次/分，提示心率降低），皮肤轻度黄染，血象：HB90g/L，RBC.3.6×10¹²/L，WBC11×10⁹/L，根据患者的临床症状、体征及实验室检查，考虑最可能的诊断为先天性甲状腺功能减退症，所以对该患儿最主要的治疗是服用甲状腺制剂（E对），且终身服用，以避免对脑发育的损害。